女性，26岁，已婚孕48天，阴道不规则出血5天，突感一侧下腹撕裂样剧痛，拒按。首先应考虑的诊断是
A. 胎动不安
B. 胞阻
C. 异位妊娠
D. 堕胎
E. 小产

正确答案：C。异位妊娠

解析：患者婚孕48天，具有停经史，阴道不规则出血5天，下腹撕裂样剧痛，首先考虑的诊断是异位妊娠（C对）。妊娠期出现腰酸腹痛、胎动下坠、阴道少量流血者，称为胎动不安（A错）。胞阻是指女性妊娠期间，出现以小腹疼痛为主的病证（B错）。堕胎中断怀孕或人工流产，导致胎儿死亡的行为（D错）。小产指妊娠12～28周内，胎儿已成形而自然殒堕为主要表现的疾病（E错）。